板障
A. 是存在于扁骨内的松质骨
B. 存在于胸骨和肋骨
C. 是存在于短骨内的松质骨
D. 只存在于颅盖骨内
E. 无

正确答案：D。只存在于颅盖骨内

解析：板障是存在于扁骨表层的松质骨，板障里有板障静脉经过（A错）。板障只存在于颅盖骨内（D对）